入院后8小时，体温上升到40℃，又发生惊厥，在抢救措施中，下列哪一项暂时不需要
A. 保持呼吸道通畅
B. 气管插管
C. 吸氧
D. 肌注或静注安定
E. 采取降温措施

正确答案：B。气管插管

解析：在小儿的热性惊厥的抢救中一般暂时不需要进行气管插管（B错，为本题正确答案）。保持呼吸道通畅（A对）、吸氧（C对）、肌注或静注安定（D对）并适当采取降温措施（E对）都是小儿热性惊厥抢救过程中的措施。